治疗温病“邪留三焦”，叶氏主张
A. 分消上下
B. 开达膜原
C. 辛开苦降
D. 芳香宣化
E. 顾护阳气

正确答案：A。分消上下

解析：邪留三焦，则湿阻热郁，气机郁滞，水道不利，见寒热起伏、胸满腹胀、溲短、苔腻等症。治宜分消走泄，宣通三焦，用杏、朴、苓或者温胆汤，此即“分消上下之势”（A对）。